关于脊髓内部结构的描述何者是错误的
A. 灰质呈"H"形,贯穿脊髓全长
B. 灰质位于脊髓中央,白质位于灰质周围
C. 脊髓是中枢神经系的低级中枢
D. 各段灰质均有前角、侧角和后角
E. 中央管向上通第四脑室

正确答案：D。各段灰质均有前角、侧角和后角

解析：脊髓灰质呈"H"形,贯穿脊髓全长（A对），位于脊髓中央，灰质的外围是白质（B对）。脊髓是中枢神经的低级部分（C对）。只有胸段和部分腰段有侧角，其余没有（D错，为本题正确选项）。中央管为细长的管道，纵贯脊髓全长，内含脑脊液，此管向上通第四脑室，向下在脊髓圆锥内扩大为一梭形的终室（E对）。